我国环境保护的基本法令是
A. 中华人民共和国水污染防治法
B. 中华人民共和国环境保护法
C. 中华人民共和国传染病防治法
D. 中华人民共和国水法
E. 地面水环境质量标准

正确答案：B。中华人民共和国环境保护法